炼钢工人补充水分较好的形式是
A. 白开水
B. 1%盐水
C. 稀饭
D. 纯净水
E. 高渗饮料

正确答案：E。高渗饮料

解析：本题考查炼钢工人补充水分较好的形式。高温环境中的关键营养问题是水和电解质平衡，合理配比地补充水和电解质，还有助于预防和纠正由于水和电解质代谢的紊乱而造成的体液酸碱失衡，因此需要高渗饮料（E对ABCD错）。